影响药物临床使用安全的因素包括
A. 药物因素
B. 患者因素
C. 医师因素
D. 药师因素
E. 护士因素

正确答案：A、B、C、D、E。药物因素；患者因素；医师因素；药师因素；护士因素